男，50岁，车祸致枕部着地，昏迷1小时，查体：P50次/分，R12次/分，BP170/100mmHg，右枕部头皮挫伤灶，GCS5分，瞳孔左：右=4mm：2mm，左侧对光反射消失，右侧肢体偏瘫。如患者颅脑损伤为左额极，颞极脑挫伤伴脑内血肿，最可能的损伤机制是
A. 挥鞭伤
B. 减速性损伤
C. 挤压伤
D. 加速性损伤
E. 坠落伤

正确答案：B。减速性损伤

解析：车祸致枕部着地，颅脑损伤为左额极，颞极脑挫伤伴脑内血肿，属于对冲伤，即减速性损伤（B对）：运动着的头部，突然撞在静止的物体后引起的损伤，发生于着力部位，以及着力部位对侧的脑组织及血管，即对冲伤。挥鞭伤（A错）：外力作用躯干，引起躯干突然加速运动，由于惯性作用，头颅的运动落后于躯干，运动的躯干再快速带动相对静止的头颅，在颅颈之间发生强烈的过伸或过屈，头颅运动有如挥动鞭子末端的运动，造成颅颈交界处延髓与脊髓连接部的损伤。挤压伤（C错）：两个或两个以上不同方向的外力同时作用于头部，颅骨变形造成的损伤。加速性损伤（D错）：相对静止的头部突然受到外力打击，头部沿外力的作用方向呈加速运动而造成的损伤，损伤部位主要发生在头部着力点，即着力伤。坠落伤（E错）是指由于坠落而受的伤。